可与醋酸铅反应用于鉴别的是
A. 阿司匹林
B. 庆大霉素
C. 苯巴比妥
D. 硫喷妥钠
E. 司可巴比妥

正确答案：D。硫喷妥钠

解析：本题考查巴比妥类药物的鉴别试验。硫代巴比妥类（D对）分子中含有硫元素，可在氢氧化钠溶液中与铅离子反应生成白色沉淀；加热后，沉淀转变为硫化铅。本试验可供硫代巴比妥类与巴比妥类的区别。